水溶性最好的环糊精
A. α-CYD
B. β-CYD
C. γ-CYD
D. HP-CYD
E. 乙基-CYD

正确答案：D。HP-CYD

解析：本题考查环糊精的性质。选项中水溶性最好的环糊精为HP-CYD（D对），羟丙基增加了环糊精的亲水性。